男，44岁，建筑工人，6小时前不慎从高处坠落摔伤，腰部疼痛，活动受限，不能站立行走。为明确是否有腰椎骨折，首选的影像学检查是
A. B超
B. MRI
C. ECT
D. CT
E. X线片

正确答案：E。X线片

解析：看骨折——X线 看椎管内情况——CT 看脊髓损伤——MRI 看周围神经损伤——肌电图。患者高处坠落后，腰部疼痛、活动受限、不能站立行走（提示可能有腰椎骨折），结合患者病史和临床表现，初步诊断该患者可能有腰椎骨折，骨折诊断首选X线片，故该患者首选影像学检查为X线片（E对）。B超（P685）（A错）主要用于检查腹膜后血肿，而对诊断骨折价值不大。MRI（P685）（B错）主要用于检查是否存在脊髓、神经损伤。ECT（C错）即发射型计算机断层扫描，主要用于甲状腺癌、乳腺癌等恶性肿瘤骨转移的检查。CT（D错）用于X线不能发现或复杂部位的骨折，价格昂贵，一般不作为首选检查。